若可摘局部义齿的人工牙齿排列在牙槽嵴顶的舌侧，其解决的方案是
A. 修改卡环臂
B. 基托重衬
C. 基托缓冲
D. 重新排列人工牙
E. 修改卡环与支托，或重新制作卡环

正确答案：D。重新排列人工牙

解析：人工牙排列的位置不当：如前牙排列覆（牙合）过大，在前伸时上颌义齿前后翘动；后牙若排在牙槽嵴颊侧，咬合时以牙槽嵴顶为支点发生翘动；若排在牙槽嵴顶舌侧，影响舌的活动。可以按选磨调的原则进行磨改，如无法改善，应重新排列人工牙。掌握“局部义齿修复后出现的问题及处理”知识点。